男性，40岁。因发热，便秘，食欲不振12天入院。查体：肝大，肋下1cm，软，脾肋下一指。血常规WBC2.7×10⁹/L，中性粒细胞52%，淋巴细胞44%，血清ALT120U/L，肥达反应：“O”1：160，“H”1：160。在治疗过程中哪项是不正确的
A. 低压灌肠
B. 高压灌肠
C. 禁用新斯的明
D. 缓泻药应用
E. 抗生素

正确答案：B。高压灌肠

解析：伤寒的治疗分为一般治疗，对症治疗，病原治疗，带菌者治疗，复发治疗，并发症治疗。其中对症治疗中有便秘症状时，禁用高压灌肠和泻剂（AD对）（B错，为本题正确答案），以免加重症状。有腹胀症状时，禁用新斯的明（C对）促进肠蠕动，以免加重症状。抗生素为病原治疗（E对）常规用药。